药师在急诊药房值班时，接听病房咨询电话，得知一新入院耐甲氧西林金黄葡萄球菌肺部感染的7岁儿童患者，出现高热、肺纹理加重，患儿肾功能正常，静脉滴注万古霉素。关于万古霉素的儿童日剂量，正确的是
A. 5mg/kg
B. 15mg/kg
C. 40mg/kg
D. 60mg/kg
E. 80mg/kg

正确答案：C。40mg/kg

解析：本题考查万古霉素的使用。万古霉素用于儿童时：儿童一日总剂量40mg/kg（C对），分3～4次服用，连服7～10日，一日量不超过2g。